男，工地外伤，多根多处肋骨骨折，呼吸时可见胸廓反常呼吸运动，现场急救最佳处理措施
A. 厚敷料加压包扎
B. 胸腔穿刺术
C. 胸腔闭式引流术
D. 胸廓固定
E. 镇痛，对症处理

正确答案：A。厚敷料加压包扎

解析：多根多处肋骨骨折现场急救：1.抢救休克；2.包扎伤口；3.妥善固定；4.迅速转运。多根肋骨骨折引起反常呼吸时，应该先用厚敷料加压包扎（A对），然后再行胸廓固定（D错）。